长期应用地西泮可产生耐受性，其特点是
A. 催眠作用的耐受性产生较快，而抗焦虑作用的耐受性产生很慢
B. 抗焦虑作用的耐受性产生较快，而催眠作用的耐受性产生很慢
C. 催眠作用不产生耐受性，而抗焦虑作用产生耐受性
D. 抗焦虑作用不产生耐受性，而催眠作用产生耐受性
E. 催眠作用及抗焦虑作用的耐受性同时产生

正确答案：A。催眠作用的耐受性产生较快，而抗焦虑作用的耐受性产生很慢